缓解急性心肌梗死疼痛的最有效药物是
A. 硝酸异山梨醇酯（消心痛）
B. 硝酸甘油
C. 吗啡
D. 安痛定
E. 硝苯地平（心痛定）

正确答案：C。吗啡

解析：吗啡（C对）对各种原因引起的疼痛均有强大的镇痛作用，可用作其他镇痛药无效的剧痛，如骨折、严重创伤、烧伤、手术后和晚期恶性肿瘤疼痛等，可用于心肌梗死的剧痛，除了镇痛作用外，还能减轻患者焦虑情绪和心脏负担。硝酸异山梨醇酯（消心痛）（A错）为长效的硝酸酯类药物，舒张血管平滑肌，临床主要用于预防心绞痛的发作。硝酸甘油（B错）可直接松弛各种平滑肌，尤其是血管平滑肌，能够有效降低心肌耗氧量、改善心肌血液分布增加缺血区供血以及抑制血小板聚集和黏附，抗血栓形成，临床主要用于各种心绞痛，对各种心绞痛均有效，为稳定型心绞痛的首选药，也可用于急性心肌梗死，减少心肌梗死并发症的发生，不是缓解疼痛的有效药物。安痛定（D错）又名复方氨林巴比妥，为解热镇痛药，临床主要用于急性高热时的紧急退热，对发热时的头痛症状也有缓解作用。硝苯地平（心痛定）（E错）属于钙通道阻滞药，对平滑肌的作用大于心脏，扩张动脉作用较强，可解除冠脉痉挛，对变异性心绞痛效果好。